采用催吐的方法清除胃内毒物适用于
A. 孕妇
B. 食道静脉曲张、胃溃疡出血的病人
C. 昏迷状态的病人
D. 神志清醒的病人
E. 冠心病的病人

正确答案：D。神志清醒的病人

解析：本题考查中毒解救。采用催吐的方法清除胃内毒物仅用于神智清醒的患者（D对）。催吐注意事项：①禁用于昏迷（C错）及休克状态者；②中毒引起抽擂、惊厥未被控制之前不宜催吐；③患有食管静脉曲张、主动脉瘤、胃溃疡出血（B错）、严重心脏病（E错）等患者不宜催吐；④孕妇（A错）慎用；⑤当呕吐时，患者头部应放低或转向一侧，以防呕吐物误吸入气管而发生窒息或引起吸入性肺炎。